属于糖尿病微血管病变的是
A. 脑血管意外
B. 冠心病
C. 糖尿病肾病
D. 肾动脉狭窄
E. 下肢坏疽

正确答案：C。糖尿病肾病

解析：糖尿病微血管病变主要表现在视网膜、肾、神经和心肌组织，其中以糖尿病肾病（C对）和视网膜病变尤为重要。糖尿病亦可合并大血管病变，主要表现为动脉粥样硬化形成，累及冠状动脉可致冠心病（B错）；累及脑动脉可致脑血管意外（A错）；累及肢体动脉可致下肢坏疽（E错）；累及肾动脉致肾动脉狭窄（D错）。